男，40岁。车祸致下腹部、髋部受伤1小时急诊来院。查体：双肺呼吸音清，未闻及干湿性啰音，心率90次/分，心律齐，未闻及杂音，腹软，下腹部淤血、青肿压痛、肌紧张反跳痛。骨盆分离和挤压试验（+）。应进行的下一步处理不包括
A. 腹部超声检查
B. X线片检查
C. 核素扫描
D. 血常规检查
E. 建立输液通道

正确答案：C。核素扫描

解析：中年男性，车祸致下腹部、髋部受伤（强大暴力外伤史），骨盆分离和挤压试验（+）（骨盆骨折的典型体征），根据患者的病史和体征，考虑诊断为骨盆骨折。由于骨盆骨折会引起大出血，因此血常规检查（D对）是否有休克、早期建立输液通道（E对）预防休克，X线片检查（B对）骨折情况、腹部超声检查（A对）腹、盆腔脏器损伤情况。所以下一步处理不包括核素扫描（C错，为本题正确选项）。